下列哪种原因所致的呕吐，用氯丙嗪治疗无效
A. 尿毒症
B. 癌症
C. 放射病
D. 药物中毒
E. 晕动病

正确答案：E。晕动病

解析：氯丙嗪属于分噻嗪类抗精神失常药，主要阻断脑内边缘系统多巴胺受体，为其抗精神病作用的主要机制，同时氯丙嗪还具有强大的镇吐作用，小剂量即可对抗多巴胺受体激动剂阿扑吗啡引起的呕吐反应，其镇吐的机制主要是，小剂量阻断延脑第四脑室底部的催吐化学感受区的D₂受体的结果，大剂量氯丙嗪可直接抑制呕吐中枢，对于尿毒症（A对）、癌症（B对）、放射病（C对）、药物中毒（D对），均可直接抑制呕吐中枢发挥镇吐作用，但由于晕动病主要是前庭刺激引起的呕吐，不能用氯丙嗪治疗（E错，为本题正确答案），可选用H₁受体阻断剂苯海拉明等进行治疗。